《中国药典》以小檗碱为质量控制成分的中药
A. 山豆根
B. 黄连
C. 洋金花
D. 千里光
E. 决明子

正确答案：B。黄连

解析：本题考查的是黄连的质量控制成分。《中国药典》以小檗碱为质量控制成分的中药黄连（B对）。黄连的有效成分主要是生物碱，已经分离出来的生物碱有小檗碱（含量最高）、巴马汀、黄连碱、甲基黄连碱、药根碱和木兰碱（属于阿朴菲型）等；大多属苄基异喹啉类衍生物，季铵型生物碱。《中国药典》以小檗碱为指标成分进行含量测定。以盐酸小檗碱计，要求味连含小檗碱不得少于5.5%，表小檗碱不得少于0.80%，黄连碱不得少于1.6%，巴马汀不得少于1.5%；要求雅连含小檗碱不得少于4.5%；要求云连含小檗碱不得少于7.0%。山豆根（A错）的主要活性成分为生物碱，这些生物碱大多属于喹喏里西啶类。其中以苦参碱和氧化苦参碱为主，《中国药典》以苦参碱和氧化苦参碱为指标成分进行含量测定要求药材两者总量不得少于0.70%，饮片两者总量不得少于0.60%。洋金花（C错）主要化学成分为莨菪烷类生物碱，由莨菪醇类和芳香族有机酸结合生成的一元酯类化合物。主要有莨菪碱（阿托品）、山莨菪碱、东莨菪碱、樟柳碱和N-去甲莨菪碱。《中国药典》以东莨菪碱为指标成分进行含量测定，要求东莨菪碱不得少于0.15%。千里光（D错）中所含有的生物碱主要为吡咯里西啶类生物碱，主要化学成分有千里光宁碱、千里光菲宁碱及痕量的阿多尼弗林碱等；同时含有黄酮苷等成分。《中国药典》以阿多尼弗林碱为指标成分进行限量测定，其中阿多尼弗林碱的含量不得过0.004%。决明子（E错）中含有蒽醌类、萘并吡咯酮类、脂肪酸类等化学成分。其中，蒽醌类化合物为其主要成分，含量约1%，主要为大黄酚、大黄素甲醚、决明素、橙黄决明素、黄决明素、美决明素、葡萄糖美决明素、葡萄糖橙黄决明素。《中国药典》以大黄酚、橙黄决明素为指标成分进行含量测定，含量分别不得少于0.20%和0.80%。